因为结构中含有二个羟基，难以通过血脑屏障的药物是
A. 硫酸阿托品
B. 氢溴酸东莨菪碱
C. 氢溴酸山莨菪碱
D. 氢溴酸加兰他敏
E. 溴丙胺太林

正确答案：C。氢溴酸山莨菪碱

解析：本题考查氢溴酸山莨菪碱。氢溴酸山莨菪碱（C对）在6位多出一个β-取向的羟基，这使得山莨菪碱分子中具有两个羟基，极性增强，难以透过血脑屏障。阿托品（A错）可通过血脑屏障，结构中只含有一个羟基。氢溴酸东莨菪碱（B错）含氧桥基团，脂溶性增强，易进入中枢神经系统，是莨菪生物碱中中枢作用最强的药物。氢溴酸加兰他敏（D错）能透过血脑屏障，结构中只含有一个羟基。溴丙胺太林（E错）为季铵化合物，是合成的M胆碱受体拮抗剂，不易透过血脑屏障。